下列对氯丙嗪叙述错误的是
A. 对刺激前庭引起的呕吐有效
B. 可使正常人体温下降
C. 可加强苯二氮䓬类药物的催眠作用
D. 可阻断脑内多巴胺受体
E. 可抑制促皮质激素的分泌

正确答案：A。对刺激前庭引起的呕吐有效

解析：氯丙嗪具有较强的镇吐作用，大剂量的氯丙嗪可以直接抑制呕吐中枢，但是不能对抗前挺刺激引起的呕吐（A错，为本题正确答案）。氯丙嗪对下丘脑体温调节中枢有很强的抑制作用，体温调节失灵，随外界环境的变化而变化（是其干扰了机体正常的散热机制的结果），与解热镇痛药不同，不但降低发热机体的体温，也能降低正常体温（B对）。苯二氮䓬类药物属于镇静催眠药，氯丙嗪可以增强镇静催眠药的中枢抑制作用（C对）。氯丙嗪可以拮抗脑内边缘系统多巴胺（DA）受体（D对），这是其抗精神病作用的主要机制。氯丙嗪对内分泌系统也有影响，通过拮抗D₂亚型受体，增加催乳素的分泌，抑制促性腺激素和糖皮质激素的分泌（E对）。